下列哪项形成部分上唇、前颌骨及上颌切牙
A. 额鼻突
B. 中鼻突
C. 侧鼻突
D. 球状突
E. 下颌突

正确答案：D。球状突

解析：中鼻突末端的两个球状突除形成部分上唇外，还形成前颌骨及上颌切牙。掌握“面部的发育”知识点。